不同种类的食物混合食用，可改善膳食中
A. 蛋白质含量
B. 表观消化率
C. 真实消化率
D. 必需氨基酸比例
E. 净利用率

正确答案：D。必需氨基酸比例